患者男，20岁，头昏乏力，发热，全身疼痛，皮肤紫癜已半月余。查体：贫血貌，体温38℃，心肺无异常，胸骨压痛，肝肋下1.5cm，脾肋下1.0cm；末梢血象：Hb60g/L，WBC2×10⁹/L，plt20×10⁹/L。则该患者最可能是
A. 再生障碍性贫血
B. 溶血性贫血
C. 急性白血病
D. 血小板减少性紫癜
E. 巨幼细胞性贫血

正确答案：C。急性白血病

解析：急性白血病是造血干细胞的恶性克隆性疾病，具有贫血、出血、发热、感染及白血病细胞浸润症状，如肝、脾、淋巴结肿大，胸骨压痛等。白细胞数可高可低，分类可见到数量不等的原始及幼稚细胞。红细胞及血小板可不同程度的减少（C对）。再生障碍性贫血网织红细胞绝对值和比例显著减少，中性粒细胞减少低于0.5×10⁹/L，血小板低于20×10⁹/L（A错）。溶血性贫血中慢性溶血多为血管外溶血，发病缓慢，表现贫血、黄疸和脾大三大特征。急性溶血发病急骤，短期大量溶血引起寒战、发热、头痛、呕吐、四肢腰背疼痛及腹痛，继之出现血红蛋白尿（B错）。血小板减少性紫癜血常规显示只有血小板减少而其他各系血细胞均在正常范围，部分患者由于失血导致缺铁，可伴有贫血（D错）。巨幼细胞性贫血多见贫血貌、胃肠道症状及神经系统症状，血象往往呈现全血细胞减少。中性粒细胞及血小板计数均可减少，但比贫血的程度为轻。血涂片中可见多数大卵圆形的红细胞（E错）。